再次应答最主要的特点是
A. 潜伏期长
B. IgG大量产生
C. IgM产生量大
D. IgG与IgM的产生量相似
E. IgG的亲和力没变化

正确答案：B。IgG大量产生